下列病变，可见肝脏肿大、压痛明显的是
A. 肝囊肿
B. 肝癌
C. 肝硬化
D. 慢性肝炎
E. 肝淤血

正确答案：B。肝癌

解析：肝癌（B对）时肝脏呈进行性增大，触诊可有明显压痛。肝囊肿（八版外科学P436）（A错）以先天性囊肿为多见，查体可见肝脏肿大，但通常无明显压痛。肝硬化（C错）早期可见肝脏肿大（八版诊断学P181），但后期常由肿大而变小（八版诊断学P196），压痛不明显。慢性肝炎（D错）、肝淤血（E错）可见肝脏肿大，但多表现为轻度弥漫性压痛（八版诊断学P181）。